具有凉血止血，清肝泻火功效的药物是
A. 三七
B. 地榆
C. 槐花
D. 仙鹤草
E. 白茅根

正确答案：C。槐花

解析：地榆、槐花、白茅根三者均为凉血止血药，均能凉血止血，除凉血止血外，槐花能清肝泻火（C对）；地榆能解毒敛疮（B错）；白茅根能清热利尿（E错）；三七、仙鹤草不能凉血止血（AD错）。